全部反应过程均在胞浆中进行的是
A. 三羧酸循环
B. 脂肪酸氧化
C. 电子传递
D. 糖酵解
E. 氧化磷酸化

正确答案：D。糖酵解

解析：糖酵解的全部反应过程均在胞浆中进行。掌握“糖分解”知识点。